城市光污染的主要来源包括
A. 白亮污染、可见光
B. 白亮污染、人工白昼
C. 白亮污染、人工白昼、彩光污染
D. 紫外线、人工白昼、红外线
E. 人工白昼、彩光污染

正确答案：C。白亮污染、人工白昼、彩光污染

解析：本题考查城市光污染的主要来源。光污染是指过量的光辐射对人体健康和人类生存环境造成的不良影响。其主要来源包括：1.白亮污染：指白天阳光照射强烈时，城市建筑物表面的玻璃幕墙、釉面砖墙、磨光大理石和各种涂料等反射光线引起的光污染；2.人工白昼：城市中的夜景照明、霓虹灯、灯箱广告等的强光直刺天空，使夜间如同白日，称为人工白昼；3.彩光污染：歌舞厅夜总会安装的黑光灯、旋转灯、荧光灯以及闪烁的彩色光源构成了彩光污染（C对ABDE错）。